最容易引起枕骨大孔疝的颅内占位性病变是
A. 颞叶肿瘤
B. 侧脑室肿瘤
C. 第二脑室肿瘤
D. 鞍区肿瘤
E. 第四脑室肿瘤

正确答案：E。第四脑室肿瘤

解析：枕骨大孔疝指颅内压增高使小脑扁桃体及延髓经枕骨大孔推挤向椎管内。延髓占据枕骨大孔的前部正中，其背侧面与脑桥背侧面、小脑构成第四脑室。第四脑室肿瘤（E对）可挤压两侧小脑扁桃体及邻近的小脑组织或延髓，经枕骨大孔向下移入椎管而发生枕骨大孔疝。颞叶肿瘤（A错）容易引发小脑幕切迹疝。侧脑室肿瘤（B错）、第二脑室肿瘤（C错）和鞍区肿瘤（D错）可引起不同程度的颅内压增高，但较少引起脑疝。